根尖周牙周膜坏死，液化形成大脓肿，形成局限性的牙槽突骨髓炎，是以上哪种的病理表现
A. 慢性根尖周肉芽肿
B. 致密性骨炎
C. 慢性根尖周脓肿
D. 急性浆液性根尖周炎
E. 急性牙槽脓肿

正确答案：E。急性牙槽脓肿

解析：本题考查急慢性根尖周炎。根尖周局部的牙周膜坏死，液化形成大脓肿，炎症迅速向周围牙槽骨扩散，形成局限性的牙槽突骨髓炎，称为急性化脓性根尖周炎，也称为急性牙槽脓肿（E对）。